四物合剂的功能是
A. 益气复脉
B. 益气固表
C. 养血调经
D. 温补气血
E. 解郁调经

正确答案：C。养血调经

解析：本题考查的是四物合剂的功能。四物合剂的功能是养血调经（C对）。四物合剂【功能】调经养血。生脉饮：【功能】益气复脉（A错），养阴生津。固本咳喘片：【功能】益气固表（B错），健脾补肾。十全大补丸：【功能】温补气血（D错）。妇科得生丸【功能】解郁调经（E错）。